腹腔神经节属于
A. 交感神经节
B. 感觉神经节
C. 副交感神经节
D. 椎旁节
E. 以上都不对

正确答案：A。交感神经节

解析：交感神经节（A对）可分为椎旁神经节和椎前神经节，椎前神经节包括腹腔神经节,肠系膜上神经节、肠系膜上神经节主动脉肾节及主动脉肾神经节等。